DIC出血与下列哪一项无关？
A. 凝血酶原减少
B. 血小板减少
C. 纤维蛋白原减少
D. 纤维蛋白降解产物减少
E. 纤溶酶增多

正确答案：D。纤维蛋白降解产物减少

解析：凝血因子大量消耗和血小板减少（B对）使血液中纤维蛋白原减少、 凝血酶原减少（A对）、FV、FVIII、FX及血小板明显减少，使凝血过程发生障碍，导致出血。纤维蛋白降解产物增多（D错，为本题正确答案）可直接引起DIC出血，纤溶酶水解纤维蛋白（原）产生的各种片段有明显的抗凝作用，如：X、Y、D片段可妨碍纤维蛋白单体聚合，Y、E片段有抗凝血酶作用。纤维蛋白原减少（C错）纤维蛋白生成减少，引起DIC出血。纤溶酶增多（E对）引起DIC出血，因为纤溶酶是活性较强的蛋白酶，除可使纤维蛋白降解外，还可水解凝血因子，如：FV、FVIII、 凝血酶、FXII等，使凝血功能发 生障碍，引起出血。